香连丸的功能是
A. 清热解毒，凉血利咽
B. 清热疏风，利咽解毒
C. 清热化湿，行气止痛
D. 清热泻火，散风止痛
E. 清热泻火，散结消肿

正确答案：C。清热化湿，行气止痛

解析：本题考查的是香连丸的功能。香连丸的功能是清热化湿，行气止痛（C对）。香连丸：【功能】清热化湿，行气止痛。板蓝根颗粒：【功能】清热解毒，凉血利咽（A错）。牛黄上清丸：【功能】清热泻火，散风止痛（D错）。功能为清热疏风，利咽解毒（B错）或清热泻火，散结消肿为（E错）的中成药，2022年考试指南未明确说明。